抑制细菌DNA促螺旋酶的药物是
A. 环丙沙星
B. 氟康唑
C. 异烟肼
D. 阿昔洛韦
E. 利福平

正确答案：A。环丙沙星

解析：本题考查喹诺酮类抗菌药。抑制细菌DNA促螺旋酶的药物是环丙沙星（A对）。环丙沙星为喹诺酮类抗菌药，能够抑制细菌DNA促螺旋酶。氟康唑（B错）属唑类抗真菌药，能诱导细胞通透性发生变化，膜渗透细胞的结构被破坏，继而造成真菌细胞的死亡。异烟肼（C错）的抗菌作用机制是抑制分枝菌酸的合成，从而使细胞丧失耐酸性、疏水性和增殖力而死亡。阿昔洛韦（D错）能抑制病毒DNA多聚酶，对RNA病毒无效。利福平（E错）的作用靶点是抑制细菌依赖DNA的RNA聚合酶。